附着在釉质或者牙骨质表面的无角化鳞状上皮为
A. 结合上皮
B. 龈沟上皮
C. 牙龈上皮
D. 缩余釉上皮
E. 龈谷上皮

正确答案：A。结合上皮

解析：结合上皮是牙龈上皮附着在牙表面的一条带状的无角化鳞状上皮，从龈沟底开始，向根尖方向附着在釉质或牙骨质的表面。结合上皮在牙面上的位置因年龄而异，年轻时附着在牙釉质上，随着年龄的增长逐渐向根方移动，中年后多位于牙骨质。掌握“牙龈”知识点。